肝病日久，两胁胀满疼痛，并见舌质瘀斑、瘀点。其病机是
A. 气滞血瘀
B. 气不摄血
C. 气随血脱
D. 气血两虚
E. 气血失和

正确答案：A。气滞血瘀

解析：气滞血瘀证是气机郁滞而致血行瘀阻所出现的证候。肝病日久，两胁胀满多因肝主疏泄，具有条达气机，调节情志的功能，情志不遂，或外邪侵袭肝脉，导致疏泄失职，肝气郁滞所致；舌质瘀斑、瘀点多因瘀血内阻所致。故其病机为气滞血瘀（A对）。气不摄血以慢性出血，尤其是便血、肌衄、崩漏及面白气短、神疲乏力、舌淡脉弱等为辨证要点，非上述症状（B错）。气随血脱以大出血的同时，出现气少息微、大汗淋漓、神情淡漠或昏聩等气脱征象为辨证要点，非上述症状（C错）。气血两虚以面色淡白或萎黄、心悸气短、眩晕乏力等为辨证要点，非上述症状（D错）。气血失和，为人造干扰项（E错）。